《疫苗流通和预防接种管理条例》规定的预防接种异常反应情形是
A. 受种者在接种时正处于某种疾病的潜伏期，接种后偶合发病
B. 因心理因素发生的个体或者群体的心因性反应
C. 合格疫苗在规范接种过程中相关各方均无过错但造成受种者机体组织器官损害
D. 因疫苗质量不合格给受种者造成的损害
E. 因疫苗本身特性引起的接种后一般反应

正确答案：C。合格疫苗在规范接种过程中相关各方均无过错但造成受种者机体组织器官损害